大型室间隔缺损后期出现青紫时肺血管的主要改变是
A. 梗阻型肺动脉高压
B. 动力型肺动脉高压
C. 肺动脉痉挛
D. 肺血增多
E. 肺血减少

正确答案：A。梗阻型肺动脉高压

解析：大型室间隔缺损，因血流动力学影响严重，存活至成人期者较少见，且常已有继发性肺血管阻塞性病变，出现梗阻型肺动脉高压改变（A对BCDE错），可致使右心压力逐步升高超过左心压力，导致右向左分流而呈现青紫。